《中国药典》中，收载阿司匹林“含量测定”的部分是
A. 一部凡例
B. 一部正文
C. 一部附录
D. 二部凡例
E. 二部正文

正确答案：E。二部正文

解析：本题考查含量测定。《中国药典》中，收载阿司匹林“含量测定”的部分是二部正文（E对）。含量测定收载在二部正文（E对）中，其中二部正文收载的药品种类包括化学药品、抗生素、生化药品、放射性药品，基本内容包括品名（中文名、汉语拼音名和英文名）、有机药物的结构式、分子式和分子量、来源和化学名称、含量和效价规定、处方、制法、性状、鉴别、检查、含量测定、类别、贮藏、制剂等。一部凡例（A错）、一部正文（B错）、一部附录（C错）收载的药品种类主要包括中药材及饮片、植物油脂和提取物、成方制剂和单味制剂。二部凡例（D错）的基本内容包括药品的名称与编排、检验方法和限度、各品种纯度和限度数值等。